多数皂苷具有
A. 氧化性
B. 升华性
C. 发泡性
D. 溶血性
E. 吸湿性

正确答案：C、D、E。发泡性；溶血性；吸湿性

解析：本题考查的是皂苷的理化性质。多数皂苷具有发泡性（C对）、溶血性（D对）与吸湿性（E对）。皂苷的理化性质：1.性状：（1）皂苷分子量较大，不易结晶，大多为无色或乳白色无定型粉末。（2）皂苷多数具有苦而辛辣味，其粉末对人体黏膜有强烈的刺激性，鼻内黏膜尤其敏感。（3）皂苷大多具有吸湿性，应干燥保存。（4）多数三萜皂苷都呈酸性。2.溶解度：大多数皂苷极性较大，易溶于水、热甲醇和乙醇等极性较大的溶剂，难溶于丙酮、乙醚等有机溶剂。3.发泡性：皂苷水溶液经强烈振荡能产生持久性的泡沫，且不因加热而消失。4.溶血性：皂苷的水溶液大多能破坏红细胞，产生溶血现象。5.熔点与旋光度：皂苷常在熔融前就已经分解，因此无明显的熔点，一般测的都是分解点。测定旋光度对判断皂苷的结构有重要意义。6.皂苷的水解：皂苷苷键的裂解，通常可采用一般苷类化合物苷键裂解的方法，如酸催化水解、氧化水解和酶解等。7.显色反应：皂苷通常应用的显色反应有Liebermann反应、醋酐-浓硫酸反应、三氯乙酸反应、五氯化锑反应及芳香醛-硫酸或高氯酸反应。氧化性（A错）为糖的理化性质。单糖分子中有醛（酮）基、伯醇基、仲醇基和邻二醇基结构单元。通常醛（酮）基最易被氧化，伯醇次之。升华性（B错）为醌类的理化性质。游离的醌类多具升华性，小分子的苯醌类及萘醌类具有挥发性，能随水蒸气馏出，可据此进行提取、精制。